患者，女性，35岁，某大学教师，3个月前因出国问题与领导争吵，而后逐渐表现出情绪低落、兴趣减退，对未来悲观失望，认为领导和同事都疏远她，常有怨天尤人的表现；能主动求医，接触良好。其主要的情绪反应是
A. 焦虑
B. 恐惧
C. 愤怒
D. 抑郁
E. 痛苦

正确答案：D。抑郁